单个细菌在固体培养基上的生长现象是形成
A. 菌苔
B. 菌团
C. 菌落
D. 菌膜
E. 菌丝

正确答案：C。菌落